各体液中，属于机体内环境的是
A. 胆汁
B. 胰液
C. 尿液
D. 脑脊液
E. 胃液

正确答案：D。脑脊液